传染源及其排出的病原体向周围传播所能波及的范围称为
A. 疫点
B. 疫区
C. 疫源地
D. 自然疫源地
E. 传染区

正确答案：C。疫源地